MHCⅡ类分子高表达于
A. 活化B细胞
B. 肥大细胞
C. 初始T细胞
D. 天然杀伤细胞
E. 中性粒细胞

正确答案：A。活化B细胞

解析：MHCⅡ类分子高表达于抗原提呈细胞（APC）和活化的T细胞（C错），APC包括：树突状细胞、单核／巨噬细胞和B细胞（A对）。天然杀伤细胞（NK细胞）是机体重要的免疫细胞，不仅与抗肿瘤、抗病毒感染和免疫调节有关，而且在某些情况下参与超敏反应和自身免疫性疾病的发生，能够识别靶细胞、杀伤介质。